患者，男，23岁，有花粉过敏史，突然出现咳嗽，打喷嚏，呼吸困难，不能平卧，喉中痰鸣，发热，汗出，舌红苔黄，脉弦滑。对诊断最有意义的检查是
A. 肺功能
B. 血气分析
C. 血常规
D. 痰涂片镜检培养
E. 心电图

正确答案：A。肺功能

解析：患者有过敏史，现突发咳嗽，打喷嚏，呼吸困难不能平卧等呼吸道症状，应及早进行肺功能检查明确诊断（A对）。血气分析能检查机体是否存在酸碱平衡失调以及缺氧和缺氧程度等，但不能快速确诊疾病（B错）。血常规常用于各类血象情况分析，可以评价患者是否贫血、感染等情况，但不能快速疾确诊疾病（C错）。痰涂片镜检培养是呼吸道疾病细菌检查重要的手段，检出肺炎链球菌、葡萄球菌、肺炎杆菌或抗酸杆菌，对诊断相应的疾病较有意义（D错）。患者以呼吸道症状为主，应尽快确认肺及气管的情况，心电图可用于辅助检查（E错）。